47岁妇女，自述阴部有一肿物脱出7个月。妇科检查见宫颈全部及部分宫体外露于阴道口，触之宫颈较长。本例选择恰当的手术应是
A. 阴道前后壁修补术
B. Manchester手术
C. 经腹子宫全切除术
D. 经阴道子宫全切及阴道前后壁修补术
E. 阴道纵隔形成术

正确答案：B。Manchester手术

解析：该患者为中年女性，因阴部有肿物脱出就诊，妇检：宫颈全部及部分宫体外露于阴道口，触之宫颈较长（Ⅱ度轻型：宫颈脱出阴道口，宫体仍在阴道内；重型：宫颈及部分宫体脱出阴道口），诊断为Ⅱ度重型子宫脱垂，恰当处理应是进行Manchester手术（曼氏手术）（B对）。其包括阴道前后壁修补、主韧带缩短及宫颈部分切除术，适用于年龄较轻、宫颈较长的子宫脱垂患者。经阴道子宫全切除及阴道前后壁修补术（P289）（D错）、经腹子宫全切除术（C错）适用于年龄较大、无需考虑生育功能的患者，后者较前者创伤大。阴道前后壁修补术（P285）（A错）适用于只有阴道前后壁膨出的患者。阴道纵隔形成术（E错）仅适合于年老体弱不能接受较大手术，且无需保留性交功能者。